患者，女，28岁，因痤疮就诊，给予异维A酸胶囊。关于该患者用药教育的说法，错误的是
A. 治疗期间及停药后3个月内应做好避孕措施
B. 治疗期间若发生皮肤黏膜干燥，应减量或停药
C. 不良反应常见，但停药后绝大多数可恢复
D. 治疗最初2个月可能导致肝酶异常，必要时定期监测肝功能
E. 部分患者用药2～4周时出现一过性皮疹加重现象

正确答案：B。治疗期间若发生皮肤黏膜干燥，应减量或停药

解析：本题考查口服维A酸类药物注意事项。患者，女，28岁，因痤疮就诊，给予异维A酸胶囊。关于该患者用药教育的说法，错误的是治疗期间若发生皮肤黏膜干燥，应减量或停药（B错，为本题正确答案）。（1）异维A酸不良反应常见，但停药后绝大多数可恢复（C对），严重不良反应少见甚至罕见。（2）最常见的不良反应是皮肤黏膜干燥，建议配合皮肤屏障修复剂使用。（3）较少见不良反应包括肌肉-骨骼疼痛、血脂升高、肝酶异常及眼睛干燥等，通常发生在治疗最初2个月，肥胖、血脂异常和肝病患者应慎用（D对）。（4）异维A酸有明确的致畸作用，育龄期女性患者及其配偶应在治疗前1个月、治疗期间及治疗结束后3个月内严格避孕（A对）。（5）已经存在明显抑郁症状或有抑郁症的患者慎用。（6）部分患者在使用2～4周时会出现皮疹短期加重现象，通常为一过性（E对），反应严重者需要减量甚至停药。